细胞膜在静息情况下，对下列离子通透性最大的是
A. Na⁺
B. K⁺
C. Cl⁻
D. Ca²⁺
E. Mg²⁺

正确答案：B。K⁺

解析：细胞膜在静息情况下，对K⁺（B对）通透性最大，因为细胞膜中存在持续开放的非门控钾通道。K⁺受浓度差驱动，由细胞内向细胞外流动，形成静息电位。